构成薄束的神经元胞体位于
A. 脊神经节内
B. 灰质后角内
C. 薄束核内
D. 脊髓灰质侧角内
E. 以上均不是

正确答案：A。脊神经节内

解析：构成薄束的神经元胞体位于同侧第5胸节及以下的脊神经节内（A对）。这些神经元细胞最后止于延髓的薄束核内（C错）。灰质后角内（B错）多接受后根外侧部传入纤维（薄髓和无髓）的侧支及从脑干下行的纤维。脊髓白质传出纤维由灰质前角运动神经元发出的纤维和侧角发出的交感节前纤维组成（D错）。